牙体缺损造成牙周症状的原因不包括
A. 破坏正常邻接关系，造成食物嵌塞，引起牙周组织炎症
B. 邻牙倾斜移位，形成创伤牙合
C. 破坏正常轴面外形，引起牙龈损伤
D. 可增加菌斑沉积，引起牙龈炎
E. 引起牙髓坏死，形成根尖周脓肿，最终形成牙周破坏

正确答案：E。引起牙髓坏死，形成根尖周脓肿，最终形成牙周破坏

解析：本题考查牙体缺损的影响。牙体缺损累及深层牙本质时，外界刺激很容易到达牙髓而引起牙髓症状，牙髓症状进一步发展引起牙髓坏死，引起根尖周病变，但这不属于牙周症状（E错，为本题的正确答案）。牙体缺损尤其是邻面缺损会破坏正常邻接关系，造成食物嵌塞，从而使菌斑积聚，严重时可引起牙周组织炎症（A对）而出现牙周症状。牙体缺损范围较大时，会使邻牙倾斜移位，形成创伤（牙合）（B对），而创伤（牙合）的存在会引起牙周膜的损伤甚至牙槽骨的吸收。牙体缺损若破坏正常轴面外形，可致轴面突度过小，食物直接冲击牙龈而引起牙龈损伤（C对）。缺损的牙体组织由于面积增加和表面粗糙等原因可增加菌斑沉积，引起牙龈炎（D对）。